支气管哮喘早期发作时最常见的血气改变是
A. pH值上升，PaO₂下降，PaCO₂降低
B. pH值上升，PaO₂下降，PaCO₂上升
C. pH值下降，PaO₂下降，PaCO₂降低
D. pH值下降，PaO₂下降，PaCO₂上升
E. PH值正常，PaO₂下降，PaCO₂上升

正确答案：A。pH值上升，PaO₂下降，PaCO₂降低

解析：支气管哮喘的主要临床表现为反复发作的喘息、气急、胸闷或咳嗽等症状，在发作时，机体可出现缺氧，并且由于过度通气可使PaCO₂下降，pH上升，表现为呼吸性碱中毒。因此支气管哮喘发作时最常见的血气改变是pH值上升，PaO₂下降，PaCO₂降低（A对）。若病情进一步恶化，呼吸肌疲劳，肺通气量不足，才可出现PaCO₂上升，pH下降（D错）。PaCO₂上升时，体内呈高碳酸血症，pH值应下降（BE错）。PaCO₂降低时，pH值应上升（C错）。